下列关于胆色素的叙述，正确的是
A. 以血红素为主要成分
B. 胆汁酸为其代谢终产物
C. 在血中主要与球蛋白结合而运输
D. 铁卟啉化合物的分解代谢产物
E. 可以转变成细胞色素

正确答案：D。铁卟啉化合物的分解代谢产物

解析：胆色素是铁卟啉化合物的分解代谢产物（D对），包括胆绿素、胆红素、胆素原和胆素。其中胆红素居于胆色素代谢的中心，是人体胆汁中的主要色素（A错），在血中主要与白蛋白结合而运输（C错），胆素原和胆素为其代谢终产物（B错）。